大补阴丸用于阴虚火旺，调配时知母应给付的是
A. 盐知母
B. 蜜知母
C. 醋知母
D. 生知母
E. 姜知母

正确答案：A。盐知母

解析：本题考查的是饮片处方药味的生品与制品。大补阴丸用于阴虚火旺，调配时知母应给付的是盐知母（A对）。饮片处方药味的生品与制品：有些处方药味虽未注明炮制要求，但药师在审方和调配过程中，对于生品制品同存，或一品多制的药味品种，可根据处方上的中医诊断和方剂（加减方）内容，判断中药的生用制用，并尽可能向处方医师提出建议。例如，黄芪是生品制品同存的，用于补气升阳，常用炙黄芪，例如补中益气汤或加减方用炙黄芪；用于固表止汗则应用生黄芪，玉屏风散方即如此。诸如此类的还有：当归功用活血养血，桃红四物汤活血行瘀，方中宜用酒当归；当归补血汤补气生血，方中宜用生当归。大黄功用泻下攻积、清热泻火、凉血解毒、逐瘀通络，大承气汤泻下用生大黄；大黄䗪虫丸或加减方破瘀消癥则宜用熟大黄。黄连有生黄连、姜黄连、萸黄连之分，泻心汤泻火解毒，用生黄连；香连丸清热化湿、行气止痛，宜用萸黄连。知母功用清热，白虎汤用于外感热病，方中用生知母（D错）；大补阴丸、知柏地黄丸等用于阴虚火旺，则宜用盐炙知母。半夏生用有毒，一般都制用，最常见的有法半夏、姜半夏（制半夏）、清半夏，都有化痰功效。但姜半夏能温中降逆，故香砂六君丸、温胆汤、小陷胸汤用姜半夏；小青龙汤治疗痰多咳喘，用法半夏为宜。